患口蹄疫病但体温正常的母畜，奶的处理原则是
A. 60℃，30分钟
B. 70℃，30分钟巴氏消毒后可食用
C. 80℃，30分钟巴氏消毒后喂饲其他禽畜
D. 禁止挤奶
E. 消毒废弃

正确答案：E。消毒废弃